吉兰－巴雷综合征的脑脊液蛋白－细胞分离是指
A. 蛋白正常，细胞数正常
B. 蛋白增高，细胞数正常
C. 蛋白增高，细胞数降低
D. 蛋白降低，细胞数增高
E. 蛋白正常，细胞数增高

正确答案：B。蛋白增高，细胞数正常

解析：脑脊液蛋白-细胞分离是GBS（吉兰－巴雷综合征）的特征之一，多数患者在发病数天内蛋白含量正常，2～4周内蛋白不同程度升高，但较少超过1.0g/L；糖和氯化物正常；白细胞计数一般＜10x10⁶/L（B对）。